男，40岁。3天前体检时B超发现右肝内一肿物，直径3cm。血AFP500μg/L。其最有效的处理方法是
A. 经股动脉插管化疗
B. 经皮肿瘤穿刺注无水酒精
C. 行肝段切除术
D. 放射治疗
E. 全身化疗

正确答案：C。行肝段切除术

解析：患者B超示右肝肿物，AFP＞400μg/L，符合肝癌的诊断标准，应诊断为肝癌。肝癌首选手术治疗，最有效的处理方法是肝段切除术（C对）。经股动脉插管化疗（A错）用于治疗不可切除的肝癌或肝癌切除后的辅助治疗。经皮肿瘤穿刺注无水酒精（B错）适用于3cm以下肿瘤。放射治疗（D错）适用于肿瘤巨大或多发不能行手术切除者。全身化疗（E错）常作为辅助治疗方式。